具有抗氧化作用的药物是
A. 考来烯胺
B. 烟酸
C. 非诺贝特
D. 洛伐他汀
E. 普罗布考

正确答案：E。普罗布考